刷牙时，将牙刷移至下一个位置放置最佳范围是
A. 1～2颗牙
B. 2～3颗牙
C. 3～4颗牙
D. 3颗牙
E. 4颗牙

正确答案：B。2～3颗牙

解析：刷完第一个部位之后，将牙刷移至下一组2～3颗牙的位置重新放置，注意与前一部位保持有重叠的区域，继续刷下一部位。掌握“自我口腔保健方法”知识点。